发生温抗体型自身免疫性溶血性贫血部分红细胞可出现的异常形态是
A. 泪滴状
B. 棘形
C. 球形
D. 椭圆形
E. 镰刀状

正确答案：C。球形

解析：温抗体型自身免疫性溶血性贫血多呈正细胞正色素性贫血，红细胞形态一般正常，但部分红细胞可出现的球形（C对）红细胞及幼红细胞等异常形态。泪滴状（A错）红细胞多见于骨髓纤维化；棘形（B错）红细胞见于多见于遗传性棘形细胞增多症、脾切除术后、尿毒症等；椭圆形（D错）红细胞多见于遗传性椭圆形细胞增多症；镰刀形（E错）红细胞主要见于镰刀细胞贫血。